关于乙型肝炎的人群分布，以下错误的是
A. 在乙型肝炎低流行区儿童HBV感染较少见
B. 女性乙肝发病率、HBsAg阳性率高于男性
C. 不同职业人群HBsAg阳性率与HBV暴露机会和强度有关
D. 不同种族和民族间HBsAg阳性率有差别
E. HBV感染具有明显的家族聚集性

正确答案：B。女性乙肝发病率、HBsAg阳性率高于男性